下列有关Ⅲ型超敏反应的发生机制，说法错误的是
A. 引起局部血小板集聚
B. 激活的嗜碱性粒细胞可释放血小板激活因子（PAF）
C. 引起局部毛细血管通透性降低
D. 激活的肥大细胞和嗜碱性粒细胞可释放组胺等炎症介质
E. 抗原抗体复合物激活补体产生的C3a和C5a可激活表达C3a和C5a受体的肥大细胞

正确答案：C。引起局部毛细血管通透性降低

解析：Ⅲ型超敏反应的发生机制：血液中的可溶性抗原与IgG或IgM结合可形成中等大小的免疫复合物。该复合物不易被单核-吞噬细胞吞噬清除，也不易通过肾小球基底膜随尿液排出体外，而沉积于毛细血管基底膜，通过下述机制引起组织损伤：抗原抗体复合物激活补体产生的C3a和C5a可激活表达C3a和C5a受体的肥大细胞和嗜碱性粒细胞；激活的肥大细胞和嗜碱性粒细胞可释放组胺等炎症介质，引起局部毛细血管通透性增加，水肿；激活的嗜碱性粒细胞可释放血小板激活因子（PAF），引起局部血小板集聚、激活，促进血栓形成，加重组织损伤、水肿：C3a和C5a可趋化中性粒细胞至免疫复合物沉积部位；中性粒细胞在吞噬免疫复合物时，释放溶酶体酶、蛋白水解酶、胶原酶和弹性纤维酶等，这些酶可损伤血管及局部组织。掌握“Ⅱ型、Ⅲ型、Ⅳ型超敏反应”知识点。